用于治疗慢性粒细胞白血病，属于酪氨酸激酶抑制剂的药物是
A. 伊马替尼
B. 吉非替尼
C. 厄洛替尼
D. 埃克替尼
E. 克唑替尼

正确答案：A。伊马替尼

解析：本题考查酪氨酸激酶抑制剂。伊马替尼（A对）为酪氨酸激酶抑制剂，主要用于治疗慢性粒细胞白血病急变期、加速期或干扰素α治疗失败后的慢性期患者。